研究者预比较两种中成药对口腔溃疡的治疗效果是否有差别，用“有效、一般、无效”作为评价疗效的指标。宜采用的统计分析方法是
A. t检验
B. 方差分析
C. Z检验
D. 秩和检验
E. 回归分析

正确答案：D。秩和检验

解析：题目中两个样本分别来自方差相等的正态分布总体的假设是不成立的，为等级资料两样本的比较，应采用Wilcoxon秩和检验（D对），其主要目的是比较两样本代表的总体分布位置是否有差别。t检验（A错）的应用前提是两个样本分别来自方差相等的正态分布总体的假设成立。方差分析（B错）通过计算假设检验的统计量F值，实现对总体均数是否有差别的推断。Z检验（C错）适用于大样本时两组均数的比较。回归分析（E错）是确定两种或两种以上变量间相互依赖的定量关系的一种统计分析方法。